患儿，5岁半，右下后牙肿痛2日，检查：右下第二乳磨牙冠大部分破坏，龋洞较深，叩（+），松动Ⅱ度，颊侧牙龈处有0.5mm×0.5mm脓肿，X线片显示根吸收达根长1/3，根分歧有低密度阴影，右下第一恒磨牙根形成2/3，上方骨板消失。本病例右下第二乳磨牙的诊断是
A. 慢性根尖炎急性发作
B. 根尖脓肿
C. 根吸收
D. 深龋
E. 慢性牙髓炎急性发作

正确答案：B。根尖脓肿

解析：本题考查乳牙牙髓病及根尖周病诊断及治疗。本病例右下第二乳磨牙的诊断是根尖脓肿（B对）。乳牙根尖周病的特点：①乳牙根尖周病早期症状不明显，往往出现急性炎症时才就诊。②慢性炎症为主，临床上的急性根尖周炎多是慢性根尖周炎急性发作（A错）引起，可出现较剧烈的自发痛、咀嚼痛和咬合痛。穿通患牙的髓腔，常见穿髓孔溢血或溢脓。③患牙松动并有叩痛。根尖部或根分歧处牙龈红肿，有的出现面部肿胀，局部淋巴结肿大，并伴有全身发热等症状。④集聚在根尖周的脓液可沿阻力小的部位排出，使牙龈出现瘘管，反复溢脓，反复肿胀。瘘管出现后，急性炎症转为慢性炎症。⑤乳牙牙周组织疏松，脓液容易从龈沟排出，加剧乳牙松动。若及时治疗，炎症很快消退。炎症消退后，牙周组织还能愈合并恢复正常。⑥X线片检查可见根尖部和根分歧部牙槽骨破坏的透射影像，是诊断慢性根尖周炎或慢性根尖周炎急性发作的重要指标。急性根尖周炎时X线片根尖部无明显改变或仅有牙周间隙增宽现象。另外X线片检查中，还需注意牙囊骨壁和恒牙胚是否受损。根据题干，X线片显示有根吸收，同时存在其他病变，因此根吸收（C错）不符合题干的诊断。病变已达根尖区，因此深龋（D错）、慢性牙髓炎急性发作（E错）不符合题干。